治疗不孕症肾阴虚型宜选用
A. 大补元煎
B. 温胞饮
C. 开郁种玉汤
D. 六味地黄丸
E. 养精种玉汤

正确答案：E。养精种玉汤

解析：不孕症肾阴虚证证候表现为婚久不孕，月经先期，量少或量多，色红无块，形体消痩，腰酸，头目眩晕，耳鸣，五心烦热；舌红苔少，脉细数。治法宜滋阴养血，调冲益精。方药选用养精种玉汤合清骨滋肾汤（E对）。大补元煎（A错）适用于子宫脱垂肾气亏虚证。温胞饮（B错）适用于宫冷不孕症。开郁种玉汤（C错）适用于不孕症肝郁型。六味地黄丸（D错）治疗肾阴亏虚证。